为了解病毒性肝炎在某地区的分布情况，研究者于2019年7月进行抽样调查部分结果如下共调查10000，男6000人女4000人，发现患者1000人，女性300人（乙肝200例，丙肝50例，其他50例），调查还发现在600例乙肝患者中有300例是2019年新发。男性病毒性肝炎新发病率为
A. 700/6000
B. 650/6000
C. 300/6000
D. 400/1000
E. 无法计算

正确答案：E。无法计算

解析：男性病毒性肝炎新发患者无法计算（E对）。